传染病传染性最强的时期是
A. 潜伏期
B. 易感期
C. 亚临床期
D. 临床症状期
E. 恢复期

正确答案：D。临床症状期

解析：本题考查传染病传染性最强的时期。临床症状期（D对ABCE错）指病人出现特异性临床症状和体征的时期。此时病人体内有大量病原体生长繁殖，又有许多利于病原体排出的临床症状，这是传染性最强的时期，具有重要的流行病学意义。